右肾下极切除术后需要缝合的是
A. 后腹膜
B. 纤维膜
C. 脂肪囊
D. 肾筋膜
E. 壁腹膜

正确答案：B。纤维膜

解析：右肾下极切除术后需要缝合的是纤维膜（B对）。